提示急性肾盂肾炎的尿液检查结果是
A. 透明管型
B. 颗粒管型
C. 白细胞管型
D. 脂肪管型
E. 蜡样管型

正确答案：C。白细胞管型

解析：提示急性肾盂肾炎的尿液检查结果是白细胞管型（C对）。透明管型（P315）（A错）病理条件下见于肾病综合征、慢性肾炎、恶性高血压和心力衰竭等。颗粒管型（P316）（B错）见于慢性肾炎、急性肾小球肾炎后期等。脂肪管型（D错）（P316）主要见于肾病综合征。蜡样管型（P316）（E错）多提示有严重的肾小管变性坏死，预后不良。